某女，25岁。既患疥癣，又患湿热黄疸。宜选用的中药是
A. 龙胆
B. 黄连
C. 水牛角
D. 苦参
E. 紫草

正确答案：D。苦参

解析：本题考查苦参的主治病证。宜选用的中药是苦参（D对）。苦参【主治病证】（1）湿疮，湿疹，疥癣，麻风，阴痒，带下。（2）湿热黄疸、泻痢、便血。（3）湿热淋痛，小便不利。龙胆（A错）【主治病证】（1）湿热下注之阴肿、阴痒、带下、阴囊湿疹，湿热黄疸。（2）肝火上炎之头痛目赤、耳聋胁痛等。（3）高热抽搐，小儿急惊，带状疱疹。黄连（B错）【主治病证】（1）湿热痞满、呕吐、泻痢、黄疸。（2）热病高热、烦躁、神昏，内热心烦不寐，胃火牙痛、口舌生疮。（3）肝火犯胃之呕吐吞酸。（4）血热妄行吐衄，痈疽肿毒，目赤肿痛，耳道疖肿，湿热疮疹。水牛角（C错）【主治病证】高热神昏，血热斑疹、吐衄，惊风。紫草（E错）【主治病证】（1）温病血热毒盛之斑疹紫黑。（2）防治麻疹。（3）疮疡，湿疹，阴痒，水火烫伤。